吗啡的不良反应有
A. 引起瞳孔扩大
B. 引起呼吸抑制
C. 引起共济失调
D. 引起急性心力衰竭
E. 引起周围神经炎

正确答案：B。引起呼吸抑制